上消化道出血的特征性表现是
A. 贫血
B. 发热
C. 呕血与黑粪
D. 氮质血症
E. 失血性周围循环衰竭

正确答案：C。呕血与黑粪

解析：上消化道出血的特征性表现是呕血与黑粪（C对）。贫血（A错）、发热（B错）、氮质血症（D错）、失血性周围循环衰竭（E错）为消化道急性大量出血的表现，可见于上、中、下消化道出血。